甲、乙、丙三家药品批发企业下列购销复方甘草片的行为，不符合规定的是
A. 乙从甲购进并销售给丙
B. 甲从药品生产企业购进并销售给乙
C. 甲从药品生产企业购进并销售给医疗机构
D. 乙从甲购进并销售给零售药店

正确答案：A。乙从甲购进并销售给丙

解析：本题考查含特殊药品复方制剂的购销管理。药品批发企业从药品批发企业购进的，只能销售给本省（区、市）的药品零售企业和医疗机构（A错，为本题正确答案）。含特殊药品复方制剂的购销管理：药品批发企业从药品上市许可持有人、药品生产企业直接购进的复方甘草片、复方地芬诺酯片等含特殊药品复方制剂，可以将此类药品销售给其他批发企业、零售企业和医疗机构（BC对）；如果从药品批发企业购进的，只能销售给本省（区、市）的药品零售企业和医疗机构（D对）。药品批发企业购进含特殊药品复方制剂时，应向供货单位索要符合规定的销售票据。销售票据、资金流和物流必须一致。药品批发企业销售含特殊药品复方制剂时，必须按规定开具销售票据提供给购货单位。销售票据、资金流和物流必须一致。根据《关于加强含可待因复方口服液体制剂管理的通知》，自2015年5月1日起，不具备第二类精神药品经营资质的企业不得再购进含可待因复方口服液体制剂，原有库存产品登记造册报所在地设区的市级人民政府负责药品监督管理的部门备案后，按规定售完为止。自2016年1月1日起，生产和进口的含可待因复方口服液体制剂必须在其包装和说明书上印有规定的标识。之前生产和进口的，在有效期内可继续流通使用。